肾小球囊壁层上皮细胞增生是哪类肾小球疾病的病理表现
A. 新月体肾炎
B. 急性肾炎
C. 膜性肾病
D. 脂性肾病
E. 膜增生性肾小球肾炎

正确答案：A。新月体肾炎

解析：肾小球囊壁层上皮细胞增生，形成新月体，是新月体肾炎（急进性肾小球肾炎）（A对）的病理表现。急性肾炎（P265）（B错）的特征性病理表现为弥漫性毛细血管内皮细胞和系膜细胞增生。膜性肾病（P268）（C错）的特征性病理表现为肾小球毛细血管壁弥漫性增厚。脂性肾病（D错）即微小病变性肾小球病（P270），其特征性病理表现为弥漫性肾小球脏层上皮细胞足突消失。膜增生性肾小球肾炎（P271）（E错）的特征性病理表现为肾小球基膜增厚、肾小球细胞增生和系膜基质增多。